卫生医师到达中毒现场调查处理时，其主要任务是
A. 进行必要和可能的抢救
B. 尽快采集患者的粪便及呕吐物
C. 收集剩余食物及餐具的涂样
D. 指导现场的消毒处理
E. 以上都是

正确答案：E。以上都是